男孩，3岁。乏力1周。查体：胸骨左缘第3～4肋间闻及4/6级吹风样收缩期杂音，肺动脉瓣区第二心音亢进，心尖部闻及短促舒张期杂音。胸部X线片：双肺充血，左、右心室均大，以左心室为著，肺动脉段突出，主动脉结偏小。最可能的诊断是
A. 室间隔缺损合并动脉导管未闭
B. 动脉导管未闭
C. 室间隔缺损
D. 房间隔缺损
E. 房间隔缺损合并动脉导管未闭

正确答案：C。室间隔缺损

解析：男性患儿，查体示胸骨左缘第3～4肋间闻及4/6级吹风样收缩期杂音（室间隔缺损典型体征），胸片见双肺充血及左右心室增大，以左心室为显著，肺动脉段突出，且有P2亢进，提示该患者有肺动脉高压，结合患者症状、体征和影像学表现，最可能的诊断是室间隔缺损（C对）。动脉导管未闭（AB错）的典型体征为胸骨左缘第2肋间粗糙的连续性机器样杂音，胸部X线表现为心影增大，主动脉结突出，左心室扩大。房间隔缺损（DE错）的典型体征为胸骨左缘第2～3肋间Ⅱ～Ⅲ级吹风样收缩期杂音，P2亢进伴固定分裂，胸部X线表现为右房、右室增大，肺动脉段突出，主动脉结小，呈典型“梨形心”。